女，46岁。因白带多半年，性交后出血1周就诊，宫颈刮片病理：宫颈鳞癌，浸润深度肉眼见癌灶最大直径≤4cm。若要清扫淋巴结，下列哪组不是清扫范围
A. 髂外
B. 腹股沟浅
C. 髂总
D. 髂内
E. 闭孔

正确答案：B。腹股沟浅

解析：该患者为中年女性，出现接触性出血，宫颈刮片病理：宫颈鳞癌，浸润深度7mm，肉眼见癌灶最大直径≤4cm，诊断为子宫颈癌ⅠB1期，宜选的手术方式是广泛性子宫切除术+盆腔淋巴结切除术，必要时行腹主动脉旁淋巴取样。盆腔淋巴结清除术包括左右髂总（C对）、髂内外（AD对）、闭孔（E对）、腹股沟深以及骶前各区域的淋巴结切除。腹股沟浅（B错，为本题正确答案）淋巴结不属于清扫范围。